下列药物属于肝药酶诱导剂的是
A. 环丙沙星
B. 胺碘酮
C. 氟康唑
D. 卡马西平
E. 西咪替丁

正确答案：D。卡马西平

解析：本题考查肝药酶诱导剂。卡马西平（D对）为肝药酶诱导剂。环丙沙星（A错）、胺碘酮（B错）、氟康唑（C错）、西咪替丁（E错）为酶抑制剂。